男，25岁。尿道口不适5天，晨起尿道口可见薄层分泌物附着。发病2周前曾有不洁性交史。查体：尿道口轻度红肿，挤压龟头尿道口可见少许浆液性分泌物。最有可能的诊断是
A. 淋病
B. 生殖道衣原体感染
C. 生殖道疱疹
D. 软下疳
E. 硬下疳

正确答案：B。生殖道衣原体感染

解析：患者男，25岁。尿道口不适5天，晨起尿道口可见薄层分泌物附着。发病2周前曾有不洁性交史。查体：尿道口轻度红肿，挤压龟头尿道口可见少许浆液性分泌物，结合患者的表现和查体结果，最可能的诊断是生殖道衣原体感染（B对）。淋病（A错）早期症状为尿频、尿急、尿痛，然后出现尿道口红肿，有稀薄黏液流出，24h后病情加重，分泌物变成黄色脓性。生殖器疱疹是单纯庖疹病毒（HSV） 感染引起的STD, 主要表现为生殖器及肛门皮肤溃疡，易复发（C错）。梅毒是由苍白密螺旋体感染引起的慢性全身性传染病。根据其病程分为早期梅毒与晚期梅毒。早期梅毒指病程在两年以内，包括一期梅毒（硬下疳）；二期梅毒（全身皮疹）；早期潜伏梅毒（感染1年内）（DE错）。